古蔡氏砷盐检查法中，碘化钾试液与酸性氯化亚锡试液的作用是
A. 还原五价的砷成三价的砷
B. 氧化三价的砷成五价的砷
C. 产生新生态的氧
D. 吸收产生的硫化氢气体
E. 吸收产生的氢气

正确答案：A。还原五价的砷成三价的砷

解析：本题考查古蔡氏砷盐检查法。酸性氯化亚锡试液与碘化钾共同将五价砷盐还原为三价砷盐（A对）。